可复性关节盘移位时弹响与开闭口运动的特点，正确的描述是
A. 开口型在弹响发生后恢复正常位置
B. 开口有弹响，而闭口则没有弹响
C. 开口，闭口时发生破碎音
D. 弹响发生前，开口偏向健侧
E. 开口，闭口均无弹响

正确答案：A。开口型在弹响发生后恢复正常位置

解析：本题考查颞下颌关节紊乱。可复性关节盘移位开闭口都有弹响，开口型在弹响发生前偏向患侧，弹响发生后回到中线（A对）。